慢性粒细胞性白血病
A. 骨髓细胞内可见Auer小体
B. 中性粒细胞碱性磷酸酶积分增高
C. Ph染色体阳性
D. 糖原染色阳性
E. 非特异性酯酶（+），阳性可被氟化钠抑制

正确答案：C。Ph染色体阳性

解析：慢性粒细胞白血病特征性的改变是细胞中出现Ph染色体（C对）和BCR-ABL融合基因；慢性粒细胞白血病时，中性粒细胞成熟障碍导致中性粒细胞碱性磷酸酶积分减低（B错）。骨髓细胞内可见Auer小体（A错）可见于RAEB-t型骨髓增生异常综合征、急性非淋巴细胞白血病等；糖原染色阳性（P572）（D错）主要见于急性淋巴细胞白血病；非特异性酯酶（+），阳性可被氟化钠抑制（P572）（E错）仅见于急性单核细胞白血病。